下利清谷，小便清长，舌淡苔白，面赤口渴，多见于
A. 表寒证
B. 真寒假热证
C. 虚寒证
D. 实寒证
E. 亡阳证

正确答案：B。真寒假热证

解析：患者有面赤口渴的表现，此属“热象”，同时又出现下利清谷，小便清长，舌淡苔白的寒证表现，提示其本质为寒证，故此为真寒假热证（B对）。